楔束
A. 贯穿脊髓全长
B. 传导下肢深感觉
C. 在同侧楔束核内交换神经元
D. 在同侧薄束核内交换神经元
E. 损伤后出现对侧深感觉消失

正确答案：C。在同侧楔束核内交换神经元

解析：深感觉、精细触觉传导通路中，第1级神经元中枢突经脊神经后根进入脊髓后索，分为长的升支和短的降支，来自第4胸节以上的升支（A错）行于后索的外侧部，形成楔束。楔束上行止于延髓同侧的楔束核并在其内交换神经元（C对），而后楔束核发出纤维交叉至对侧并继续上行，最后投射至中央后回、中央旁小叶，因而楔束传导的是同侧肢体深感觉，损伤后出现同侧上肢、躯干深感觉消失（BE错）。